依据中医藏象学说，与肝直接相关的有
A. 精明
B. 筋膜
C. 汗液
D. 黑睛
E. 泪液

正确答案：A、B、D、E。精明；筋膜；黑睛；泪液

解析：本题考查的是肝与志、液、体、华、窍的关系。依据中医藏象学说，与肝直接相关的有精明（A对）、筋膜（B对）、黑睛（D对）与泪液（E对）。肝与志、液、体、华、窍的关系：1.肝在志为怒：怒是一种不良的情志刺激。怒与肝的关系最为密切。一方面，怒可以伤肝，导致疏泄失常，肝气亢奋，血随气涌，可见面红目赤，心烦易怒，甚则可见吐血、衄血、猝然昏倒、不省人事。另一方面，如肝失疏泄，也可致情志失常，表现为情绪不宁、烦躁易怒。2.肝在液为泪：肝开窍于目，泪具有润泽和保护眼睛的功能。泪与肝的关系密切，在病变情况下，可见泪的分泌异常。例如，肝的阴血不足，则两目干涩；肝经风热，则两目红赤、羞光流泪；肝经湿热，则目眵增多等。3.肝在体合筋，其华在爪：（1）筋是连接肌肉、骨和关节的组织，包括肌腱、韧带等。筋附着于骨而聚于关节，是联结关节肌肉、主司运动的组织。筋有赖于肝血的充分滋养，才能强健有力，活动自如。如肝血虚少，血不养筋，则肢体麻木、屈伸不利，甚则拘挛震颤；热邪侵袭人体，燔灼肝经，劫夺肝阴，筋膜失养，则见四肢抽搐、颈项强直、角弓反张等动风之象。（2）爪，即爪甲，包括指甲和趾甲。爪乃筋之延续的部分，故称“爪为筋之余”。爪甲的荣枯，也就可以反映肝血的盛衰。爪甲依赖于肝血的滋养，肝血充足，则爪甲坚韧明亮，红润光泽；肝血不足，则爪甲软薄，甚则变形脆裂。4.肝在窍为目：目，又称“精明”，是视觉器官，具有视物的功能。在结构上，肝的经脉联系于目。肝之藏血与疏泄功能，与目的视觉生理密切相关。例如，肝火上炎，则两目红肿热痛；肝阴虚而阳亢，则头目眩晕。此外，五脏六腑之精气皆上注于目，故观察眼睛的变化，即可了解全身功能的盛衰。中医“五轮学说”把眼睛各部分与五藏相属，黑睛为风轮，属肝；两眦血络为血轮，属心；上下眼睑为肉轮，属脾；白睛为气轮，属肺；瞳孔为水轮，属肾。汗液（C错）与心有关。心与志、液、体、华、窍的关系：1.心在志为喜；2.心在液为汗；3.心在体合脉，其华在面；4.心在窍为舌。